对流动人口中的传染性非典型肺炎病人、疑似病人处理的原则是
A. 就地控制、就地治疗、就地康复
B. 就地隔离、就地治疗、就地康复
C. 就地控制、就地观察、就地治疗
D. 就地隔离、就地观察、就地治疗
E. 就地观察、就地治疗、就地康复

正确答案：D。就地隔离、就地观察、就地治疗

解析：传染性非典型肺炎防治时实行医疗救助主要包括：①对流动人口中的病人、疑似病人应当按照就地隔离、就地观察、就地治疗（D对）的原则，及时送当地指定的专门收治病人和疑似病人的医疗机构治疗；②医疗机构收治病人或者疑似病人，实行先收治、后结算的办法，任何医疗机构不得以费用为由拒收病人；③对农民（含进城务工农民）和城镇困难群众中的传染性非典型肺炎病人实行免费医疗，所发生救治费用由政府负担，具体办法按国家有关部门规定执行。